下列哪项不是阴水证的临床表现
A. 水肿先从下肢肿起
B. 下半身肿痛
C. 腰酸肢冷
D. 水肿皮薄光亮
E. 起病缓，病程长

正确答案：D。水肿皮薄光亮

解析：选项D水肿皮薄光亮为阳水的临床表现，由于三焦俱病，水无去路，泛溢肌肤，来势迅猛，迅速蔓延全身所致（D对）。阴水证中因脾虚不运水湿，肾虚不升清降浊，水势趋下，故水肿先从下肢肿起，下半身肿痛（AB错）。阴水证中因肾阳虚，不能温养腰膝，故腰酸肢冷（C错）。阴水证多由久病正虚，水肿久延不愈，故起病缓，病程长（E错）。